下列哪项为小儿内伤咳嗽发病的常见病因是
A. 水饮内停
B. 阴常不足
C. 阳常有余
D. 痰浊内生
E. 瘀血内阻

正确答案：D。痰浊内生

解析：咳嗽是小儿常见的一种肺系病症，有声无痰为咳，有痰无声为嗖，有声有痰谓之咳嗽，分为外感咳嗽和内伤咳嗽，内伤咳嗽的病因包括痰热蕴肺、痰湿蕴肺、肺脾气虚和肺阴亏虚。小儿脾常不足，易为乳食、生冷所伤，则使脾失健运，水谷不能化生精微，酿为浊痰，上贮于肺，痰阻气道，肺失宣降，气机不畅，则致咳嗽痰多，痰色白而稀，故痰浊内生属于小儿内伤咳嗽发病的常见病因（D对）。水饮内停（A错）是指人体水液运行输布失常，水停为饮，水饮聚集于机体胸腹、胃肠或四肢等不同部位。朱丹溪认为精血津液是人身的宝贵物质，人的生命活动，不断消耗，易损难复，故阴常不足（B错）。朱丹溪认为饮食失节，嗜酒纵欲，伤伐过度，则阳热易亢，虚火妄动，故阳常有余（C错）。瘀血内阻（E错）是指因年老气血运行迟缓，或产后气血虚弱，劳倦过度，或情志所伤，或胞宫内败血停滞，致血滞成瘀。